构成腋窝后壁的肌肉有
A. 冈上肌、冈下肌
B. 冈上肌、冈下肌、小圆肌
C. 肩胛下肌
D. 肩胛下肌、大圆肌、背阔肌
E. 前锯肌、肩胛下肌

正确答案：D。肩胛下肌、大圆肌、背阔肌

解析：构成腋窝后壁的肌肉有肩胛下肌、大圆肌、背阔肌（D对）。